牙槽突骨折常用
A. 保守治疗
B. 单颌固定
C. 颌间结扎
D. 切开复位内固定术
E. 暂不处理，随访

正确答案：B。单颌固定

解析：单颌固定是指在发生骨折的颌骨上进行固定，而不将上、下颌骨同时固定在一起的方法。常用的有单颌牙弓夹板固定即将成品或弯制的牙弓夹板横跨骨折线安置到两侧健康牙上，用金属丝将夹板与牙体逐个结扎起来，利用健康牙固定骨折的方法。临床上常用于牙槽突骨折和移位不大的颏部线形骨折。掌握“牙槽突骨折、颌骨骨折”知识点。